我国《尘肺病诊断标准》适用于
A. 矽肺
B. 水泥尘肺
C. 铝尘肺
D. 电焊工尘肺
E. 以上所有

正确答案：E。以上所有